下列药物中，在体内产生活性代谢产物而发挥抗病毒作用，属于前药的是
A. 阿昔洛韦
B. 伐昔洛韦
C. 更昔洛韦
D. 齐多夫定
E. 司他夫定

正确答案：B。伐昔洛韦

解析：本题考查抗疱疹病毒药。伐昔洛韦（B对）是阿昔洛韦的前药，进入人体后迅速分解为L-缬氨酸和阿昔洛韦。前者在体内参与正常生理生化代谢，后者发挥抗病毒作用。